某纺织女工，年龄35岁。在某纺织厂从事纺纱和织布工作已10年以上。近来主诉耳鸣、听力下降等症状。对此女工应作何种处理
A. 继续从事纺织行业工作，减少接触噪声时间
B. 继续从事接触较低噪声工作
C. 调离原工作岗位，从事非噪声作业工作
D. 在原工作岗位作辅助工
E. 继续从事纺织行业工作，工作时戴耳塞

正确答案：C。调离原工作岗位，从事非噪声作业工作

解析：本题考查职业性噪声聋的处理原则。职业性噪声聋是指劳动者在工作过程中，由于长期接触噪声而发生的一种渐进性的感音性听觉损伤，大多数病人为双耳对称。该女工由于长时间的噪声环境工作，出现相应听力下降的症状，符合职业性噪声聋的诊断标准。当发生职业性噪声聋时，应将噪声聋病人调离工作岗位，从事非噪声作业工作（C对ABDE错）。